某些药物因制剂工艺原因，服药后药物骨架不能被吸收，会随粪便排岀体外，且外形酷似完整药物，需提前告知患者，以免发生误解。存在这种情况的药品有
A. 甲磺酸多沙唑嗪控释片（可多华）
B. 氯化钾缓释片（补达秀）
C. 硝苯地平控释片（拜新同）
D. 胰酶肠溶胶囊（得每通）
E. 琥珀酸美托洛尔缓释片（倍他乐克）

正确答案：A、B、C。甲磺酸多沙唑嗪控释片（可多华）；氯化钾缓释片（补达秀）；硝苯地平控释片（拜新同）

解析：本题考查药物的给药途径与用药方法。有些缓、控释制剂如甲磺酸多沙唑嗪控释片（可多华）（A对）、氯化钾缓释片（补达秀）（B对）、硝苯地平控释片（拜新同）（C对）等服用后，药物骨架不能被吸收，会随粪便排出体外，而排出体外的缓、控释结构酷似完整药片，需提前告知患者，以免引起误解。胰酶肠溶胶囊（得每通）（D错）不宜嚼碎服用，应整粒吞服。琥珀酸美托洛尔缓释片（倍他乐克）（E错）建议患者整粒吞服。